感受暑湿，身热烦渴，小便不利或大便泄泻者，治宜选用
A. 六一散
B. 桂苓甘露散
C. 藿香正气散
D. 香薷散
E. 参苓白术散

正确答案：A。六一散

解析：感受暑湿，暑为阳邪，其性炎热，暑气通心，暑热伤人，则见身热、心烦；暑热伤津，则口渴；暑邪夹湿，湿性黏滞，湿聚膀胱，气化不行，故见小便不利；湿邪流注于肠间，则泄泻。故此证当为暑热夹湿，治以清暑利湿，方选六一散（A对），方中滑石甘淡性寒，质重而滑，寒能清热，淡能渗利，重能走下，滑能利窍，善清解暑热、通利水道，令暑热水湿从小便而去，为君药。甘草生用，甘平偏凉，清热泻火，益气和中，与滑石相配，防寒凉伐胃。二药合用，共奏清暑利湿之效。桂苓甘露散功用为清暑解热，化气利湿，主治暑湿证（B错）。藿香正气散功用为解表化湿，理气和中，主治外感风寒，内伤湿滞证（C错）。香薷散功用为祛暑解表，化湿和中，主治阴暑（D错）。参苓白术散功用为益气健脾，渗湿止泻，主治脾虚湿盛证（E错）。